在片剂的脆碎度检查中，被测片剂的减失重量不得超过
A. 0.001
B. 0.25
C. 0.005
D. 0.01
E. 0.02

正确答案：D。0.01

解析：本题考查脆碎度。脆碎度反映片剂的抗磨损和抗振动能力，在片剂的脆碎度检查中，被测片剂的减失重量小于1%（D对）为合格片剂。